男，50岁。呕血3小时。晚餐进食粗糙食物后突发呕鲜血，量约600ml。乙肝病史30年，曾有黑便史。查体：T36.5℃，P110次／分，R20次／分，BP110/70mmHg。皮肤未见出血点，可见肝掌。双肺呼吸音清，未闻及干湿性啰音，心律齐。腹软，无压痛，肝肋下未触及，脾肋下2cm。该患者发生呕血最可能的原因是
A. 胃溃疡大出血
B. 十二指肠溃疡大出血
C. 急性胆道大出血
D. 食管胃底曲张静脉破裂
E. 急性糜烂性胃炎

正确答案：D。食管胃底曲张静脉破裂

解析：中年男性患者，呕血3小时。晚餐进食粗糙食物后突发呕鲜血，量约600ml。乙肝病史30年，曾有黑便史。皮肤未见出血点，可见肝掌（肝功能减退表现）。脾肋下2cm（肝硬化门静脉高压的表现）。综合患者的症状、体征和辅助检查，初步诊断为肝硬化，该患者发生呕血最可能的原因是食管胃底曲张静脉破裂（D对）。胃溃疡大出血（A错）、十二指肠溃疡大出血（B错）为慢性病程，周期性发作，节律性上腹痛，有NSAIDs服药史。急性胆道大出血（C错）、急性糜烂性胃炎（E错）均无肝硬化的表现。